高热患者容易发生
A. 低渗性脱水
B. 等渗性脱水
C. 高渗性脱水
D. 水中毒
E. 水肿

正确答案：C。高渗性脱水

解析：高热患者由于皮肤和呼吸道水分蒸发的增加及退热期的大量出汗，使水分大量丢失，高于钠的丢失，故易引起高渗性脱水（C对）。因此，高热患者退热期应及时补充水分和适量的电解质。